与产生阻塞性通气不足关系最密切的因素是
A. 气道长度.
B. 气道内径
C. 气流速度
D. 气体密度
E. 气流形式

正确答案：B。气道内径

解析：影响气道阻力的因索有：气道内径、长度和形态、气流速度和形式等，其中关系最密切的因素是气道内径（B对）。